患者王某，15岁，因患感冒、咳嗽，到社区卫生服务中心就诊，经问诊结合血常规检查结果，医师开具了左氧氟沙星片、复方磷酸可特因口服溶液、感冒清热颗粒（外包装为红色OTC标识）的处方。药师审方后，认为左氧氟沙星片不宜用于18岁以下小儿及青少年，建议调整抗菌药物，改用阿奇霉素片。取药时，药师交代用药注意事项。医师为王某开具的复方磷酸可待因口服溶液的处方不得超过
A. 1日常用量
B. 3日常用量
C. 15日常用量
D. 7日常用量

正确答案：D。7日常用量

解析：本题考查处方限量。医师为王某开具的复方磷酸可待因口服溶液的处方不得超过7日常用量（D对）。为门（急）诊一般患者开具的麻醉药品注射剂，每张处方为一次常用量（A错）；控缓释制剂，每张处方不得超过7日常用量；其他剂型，每张处方不得超过3日常用量（B错）。第一类精神药品处方限量同麻醉药品；哌醋甲酯用于治疗儿童多动症时，每张处方不得超过15日常用量（C错）。第二类精神药品一般每张处方不得超过7日常用量；对于慢性病或某些特殊情况的患者，处方用量可以适当延长，医师应当注明理由。